混悬型滴鼻剂应检查的是
A. 黏附力
B. 装量差异
C. 递送均一性
D. 微细粒子剂量
E. 沉降体积比

正确答案：E。沉降体积比

解析：本题考查沉降体积比检查。混悬型滴鼻剂应作沉降体积比（E对）检查；黏附力（A错）是贴剂的检查项目；装量差异（B错）是单剂量包装制剂的检查项目；递送剂量均一性（C错）是定量剂型及多剂量贮库型药剂检查项目；微细粒子剂量（D错）是气雾剂的检查项目。